在混悬剂中加入适当电解质，使混悬微粒形成疏松聚集体的过程是
A. 絮凝
B. 增溶
C. 助溶
D. 潜溶
E. 盐析

正确答案：A。絮凝

解析：本题考查混悬剂。絮凝（A对）是指在混悬剂中加入适当电解质，使混悬微粒形成疏松聚集体的过程。增溶（B错）是指难溶性药物在表面活性剂的作用下，在溶剂中增加溶解度并形成溶液的过程。助溶（C错）是指由于第三种物质的存在而增加难溶性药物在某种溶剂（一般为水）中的溶解度而不降低活性的现象。潜溶（D错）是指药物在一定比例混合溶剂中溶解度大于在单一溶剂中溶解度的现象。盐析（E错）一般是指溶液中加入无机盐类而使某种物质溶解度降低而析出的过程。